根据《中华人民共和国药品管理法》，对不良反应大并危害人体健康的药品，组织调查、撤销其批准文号的部门是
A. 国务院卫生行政部门
B. 省级药品监督管理部门
C. 地市级卫生行政部门
D. 国家药品监督管理部门
E. 地市级药品监督管理部门

正确答案：D。国家药品监督管理部门

解析：本题考查药品上市后管理。根据《中华人民共和国药品管理法》，对不良反应大并危害人体健康的药品，组织调查、撤销其批准文号的部门是国家药品监督管理部门（D对）。《中华人民共和国药品管理法》第八十三条规定，药品上市许可持有人应当对已上市药品的安全性、有效性和质量可控性定期开展上市后评价。必要时，国务院药品监督管理部门可以责令药品上市许可持有人开展上市后评价或者直接组织开展上市后评价。经评价，对疗效不确切、不良反应大或者因其他原因危害人体健康的药品，应当注销药品注册证书。